反映局部肌肉的疲劳宜采用
A. 体温
B. 皮温
C. 肌电
D. 肺通气量
E. 脑诱发电位

正确答案：C。肌电